葡萄糖注射液应检查的杂质是
A. 对氨基苯甲酸
B. 游离水杨酸
C. 莨菪碱
D. 对氨基酚
E. 5-羟甲基糖醛

正确答案：E。5-羟甲基糖醛

解析：本题考查葡萄糖注射液杂质的检查。